对胃酸分泌抑制作用强的药物是
A. 阿托品
B. 东莨菪碱
C. 山莨菪碱
D. 后马托品
E. 哌仑西平

正确答案：E。哌仑西平